从事过度紧张的作业，可出现瞳孔直径变大、焦虑、感情冷漠、抑郁或兴奋、易怒，这些可归纳于
A. 行为表现
B. 性格表现
C. 心理反应
D. 生物反应
E. 生理反应

正确答案：C。心理反应